筛选试验的金标准是指当前
A. 病人最乐意接受的诊断疾病的方法
B. 临床公认的诊断疾病最可靠的方法
C. 临床上最先进的诊断疾病的方法
D. 临床上最快速、简单的诊断方法
E. 临床上最新发明的诊断方法

正确答案：B。临床公认的诊断疾病最可靠的方法

解析：本题考查筛选试验的金标准。筛选试验的金标准是指当前临床公认的诊断疾病最可靠的方法（B对）。筛检试验的金标准是当前临床医学界公认的诊断疾病的最准确可靠的方法，目的是准确区分受试者对象是否为某病患者。病人最乐意接受、最先进、最新发明的诊断方法不一定是准确可靠的诊断疾病的方法，不能准确区分受试对象的话就不能准确识别外表健康但可能有病的个体（ACE错）。快速简单是对筛检方法的要求，不是对“金标准”的要求（D错）。